关于疾病监测的论述，正确的是
A. 疾病监测是一种横向研究
B. 疾病监测获得的信息应该纵向反馈，而不能横向反馈
C. 漏报调查属于主动监测
D. 常规报告系统是一种主动监测
E. 哨点监测属于被动监测

正确答案：C。漏报调查属于主动监测

解析：主动监测是根据特殊需要上级单位专门组织调查收集资料，其中漏报调查属于主动监测（C对）。疾病监测是长期、连续、系统的监测，是动态的，不是横向研究（A错）。疾病监测获得的信息既可以纵向反馈，也可以横向反馈（B错）。被动监测是下级单位常规的向上级单位报告监测资料，而上级单位被动的接受。可见常规报告系统是一种被动监测（D错）。哨点监测是指为了更清楚地掌握特定的公共卫生间题，依据疾病、健康状况或危险因素分布特点，选择若干个有代表性的地区和（或）人群作为监测点，按照统 规定要求收集资料。这种监测方式收集资料可以是被动的，也可以是主动的（E错）。